属于细胞内受体的是
A. 胰岛素受体
B. 甲状腺激素受体
C. β受体
D. N受体
E. 表皮生长因子受体

正确答案：B。甲状腺激素受体

解析：本题考查受体的类型。甾体激素、甲状腺激素（B对）、维生素D及维生素A受体均属于细胞内受体。